玉屏风散的功用有
A. 固表
B. 涩肠
C. 止遗
D. 固冲
E. 补肾

正确答案：A。固表

解析：本题考查玉屏风散的功用。玉屏风散为补益剂中的补气剂其功用为益气固表止汗（A对）。其他选项均不是玉屏风散的功用（BCDE错）。